下列哪些表现不是颞下颌关节双侧脱位的表现
A. 颏部中线及下前牙中线偏向健侧
B. X线片可见髁突脱位于关节结节前上方
C. 触诊耳屏前方有凹陷
D. 下颌前伸，两颊变平
E. 下颌运动异常，患者前牙开（牙合）、反（牙合）

正确答案：A。颏部中线及下前牙中线偏向健侧

解析：急性前脱位可为单侧或双侧。双侧脱位的症状是：①下颌运动异常，患者呈开口状，说话、咀嚼和吞咽均有困难；检查时可见前牙开（牙合）、反（牙合）。②下颌前伸，两颊变平。③触诊耳屏前方有凹陷，在颧弓下可触到脱位的髁突。④X线片可见髁突脱位于关节结节前上方。单侧急性前脱位者，颏部中线及下前牙中线偏向健侧，健侧后牙反（牙合）。掌握“颞下颌关节紊乱”知识点。